以下哪项为牙源性肿瘤
A. 含牙囊肿
B. 萌出囊肿
C. 黏液囊肿
D. 黏液纤维瘤
E. Warthin瘤

正确答案：D。黏液纤维瘤

解析：牙源性黏液瘤又称为黏液瘤或黏液纤维瘤，发生于颌骨的黏液瘤与牙源性间叶组织在形态学上的相似以及肿瘤中有时可见的牙源性上皮剩余，均提示该瘤是牙源性的。掌握“牙源性黏液瘤、成牙骨质细胞瘤”知识点。